用手工器械洁治时，应注意
A. 器械与牙面、软组织的适应度
B. 工作端与牙面的工作角度
C. 使用手腕的推拉力
D. 洁治方向为垂直、水平、斜向
E. 以上都是

正确答案：E。以上都是

解析：本题考查手用器械洁治的基本方法。使用手工器械进行洁治时，应注意：器械与牙面、软组织的适应度（A对），对不同的洁治部位，选择合适的手工器械。工作端与牙面的工作角度（B对），为刀刃与牙面呈80°角左右。握持器械的方法为改良握笔法，将无名指放于被洁治牙附近的牙作为支点，使用手腕部推拉力（C对）刮除牙石。洁治动作以垂直、水平或斜向等拉推进行（D对），每刮一下应与前一动作有重叠，以免遗漏牙石。（ABCD均对，故E为本题的正确选项）。